桡神经高位损伤后可导致
A. 臂不能内收
B. 臂不能屈
C. 前臂不能屈
D. 肱桡肌瘫痪
E. 臂不能外展

正确答案：D。肱桡肌瘫痪

解析：桡神经支配肱三头肌、肘肌、肱桡肌和桡侧腕长伸肌，桡神经高位损伤后可导致肱桡肌瘫痪（D对）。